环境卫生学主要研究
A. 自然环境与人群健康的关系
B. 生活环境与人群健康的关系
C. 自然环境和生活环境与人群健康的关系
D. 生活居住环境和自然环境与人群健康的关系
E. 自然环境、生活居住环境、工作学习环境与人群健康的关系

正确答案：C。自然环境和生活环境与人群健康的关系

解析：本题考查环境卫生学的研究内容。环境卫生学是研究自然环境和生活环境与人群健康的关系（C对ABDE错），揭示环境因素对人群健康影响的发生、发展规律，为充分利用环境有益因素和控制环境有害因素提出卫生要求和预防对策，增进人体健康，维护和提高人群健康水平的学科。